关于药品安全信息公开的说法，错误的是
A. 药品安全信息公开应当遵循全面、及时、准确、客观、公正的原则
B. 药品安全监管信息公开清单包括公开事项、具体内容、公开时限、公开部门等
C. 公开的具体内容包括药品的产品注册、生产经营许可、广告审查、监督检查、监督抽验、行政处罚等信息
D. 县级以上药品监督管理部负责公布本地药品安全信息

正确答案：D。县级以上药品监督管理部负责公布本地药品安全信息

解析：本题考查药品安全信息公开管理。关于药品安全信息公开的说法，错误的是县级以上药品监督管理部负责公布本地药品安全信息（D错，为本题正确答案）。县级以上药品监督管理部依据法定职责和工作权限，负责本辖区内的药品安全信用分类管理工作。药品安全信息公开应当遵循全面、及时、准确、客观、公正的原则（A对）。药品监督管理部门依职责建立药品安全监管信息公开清单和信息，并在其政府网站及时公布、更新，接受社会监督。药品安全监管信息公开清单包括公开事项、具体内容、公开时限、公开部门等（B对）。公开的内容包括，药品的产品注册、生产经营许可、广告审查、监督检查、监督抽检、行政处罚（C对）以及其他监管活动中形成的以一定形式制作保存的信息的主动公开。